属于O/W软膏剂基质乳化剂的是
A. 十八醇
B. 月桂醇硫酸钠
C. 司盘80
D. 甘油
E. 羟苯乙酯

正确答案：B。月桂醇硫酸钠

解析：本题考查软膏剂。月桂醇硫酸钠（B对）属于O/W软膏剂基质乳化剂；十八醇（A错）为软膏剂的油相基质；司盘80（C错）为W/O型乳化剂；甘油（D错）常作为软膏剂的保湿剂使用；羟苯乙酯（E错）常作为软膏剂的防腐剂使用。